下列有关吗啡与哌替啶的叙述错误的是
A. 哌替啶的等效量效价强度是吗啡的1/10
B. 等效量时对呼吸的抑制作用与吗啡基本相等
C. 吗啡的镇咳作用比哌替啶强
D. 吗啡的成瘾性比哌替啶强
E. 两药对平滑肌的作用相同，都可用于止泻

正确答案：E。两药对平滑肌的作用相同，都可用于止泻

解析：哌替啶对胃肠道平滑肌及括约肌的作用与吗啡相似，但较弱；无明显止泻和引起便秘作用（E错，为本题正确答案）。哌替啶是人工合成的阿片μ受体激动药，是目前临床应用最广泛的人工合成镇痛药，其镇痛作用弱于吗啡，效价强度相当于吗啡的1/10-1/8（A对）。哌替啶与吗啡在等效剂量时抑制呼吸的程度相当（B对），但维持时间较短，对呼吸功能正常者无明显影响，但对肺功能不良及颅脑损伤者可危及生命。哌替啶轻度抑制咳嗽中枢，镇咳作用弱于吗啡（C对）。哌替啶在镇痛的同时。可产生明显的镇静作用，消除患者的紧张烦躁情绪，少数患者有欣快感，吗啡可产生欣快感，产生耐受性和成瘾性（D对）。